功专止咳祛痰的中成药是
A. 半夏止咳糖浆
B. 二母宁嗽丸
C. 桂龙咳喘宁胶囊
D. 通宣理肺丸
E. 川贝枇杷露

正确答案：A。半夏止咳糖浆